含有生地、麦冬、玄参的方剂是
A. 杏苏散
B. 清燥救肺汤
C. 桑杏汤
D. 麦门冬汤
E. 养阴清肺汤

正确答案：E。养阴清肺汤

解析：该题考查养阴清肺汤的组成。养阴清肺汤功能养阴清肺，解毒利咽，由生地黄、麦冬、生甘草、玄参、贝母、丹皮、薄荷、白芍组成（E对）。趣记：养阴清肺汤 杨阴清非卖薄荷梢，选贝母弟担草。――养阴清肺麦薄荷芍，玄贝母弟丹草。